反跳反应又称
A. 继发反应
B. 毒性反应
C. 特异质反应
D. 后遗效应
E. 停药反应

正确答案：E。停药反应

解析：本题考查药品不良反应。反跳反应又称停药反应（E对）。停药反应是指患者长期应用某种药物，突然停药后出现原有疾病加剧的现象，又称回跃反应或反跳。例如，长期应用β受体阻断药普萘洛尔治疗高血压、心绞痛等，可使β受体密度上调而对内源性去甲肾上腺素能神经递质的敏感性增高，如突然停药，则会出现血压升高或心绞痛发作。继发反应（A错）是继发于药物治疗作用之后的不良反应，是治疗剂量下治疗作用本身带来的间接结果。毒性反应（B错）是指在剂量过大或药物在体内蓄积过多时发生的危害性反应。特异质反应（C错）是指少数特异体质患者对某些药物反应异常敏感。后遗效应（D错）是指在停药后血药浓度已降低至最低有效浓度以下时仍残存的药理效应。